大剂量用于治疗良性前列腺增生，而小剂量能促进头发生长，可用于雄激素源性脱发治疗的药物是
A. 十一酸睾酮
B. 西地那非
C. 特拉唑嗪
D. 坦洛新
E. 非那雄胺

正确答案：E。非那雄胺

解析：本题考查非那雄胺。大剂量用于治疗良性前列腺增生，而小剂量能促进头发生长，可用于雄激素源性脱发治疗的药物是非那雄胺（E对）。非那雄胺能够促进头发生长，临床上用于治疗雄激素源性脱发，用于治疗和控制良性前列腺增生症以及预防泌尿系统事件：①降低发生急性尿潴留的危险性；②降低需经尿道切除前列腺的危险性，本品可使增生的前列腺体积缩小，改善尿流，改善与前列腺增生有关的症状。十一酸睾酮（A错）适用于男性原发性、继发性性腺功能减退的替代治疗等，临床用于：①男性雄激素缺乏症（睾丸切除术后、性功能减退、生殖器功能不足、更年期）；②男孩体质性青春期延迟；③乳腺癌转移的姑息性治疗；④再生障碍性贫血的辅助治疗；⑤中老年部分性雄激素缺乏综合征；⑥女性进行性乳腺癌。西地那非（B错）为5型磷酸二脂酶抑制剂，用于治疗勃起功能障碍。特拉唑嗪（C错）为泌尿系统药，用于良性前列腺增生症和高血压的治疗。坦洛新（D错）用于因前列腺增生所致的排尿障碍等症状，如尿频，夜尿增多、排尿困难等，另外肾功能不全者禁用。